局麻药引起局麻作用的电生理学机制是
A. 促进Na⁺内流
B. 阻止Na⁺内流
C. 促进Ca²⁺内流
D. 阻止Ca²⁺内流
E. 阻止K⁺外流

正确答案：B。阻止Na⁺内流